女，55岁。突发心悸2小时。心律绝对不齐，心音强弱不等。心悸最可能的原因是
A. 窦性心律不齐
B. 窦性心动过速
C. 心房颤动
D. 室性早搏
E. 房性早搏

正确答案：C。心房颤动

解析：心悸是一个常见症状。患者自觉心跳或心慌，伴有心前区不适感，当心率缓慢常感到心脏搏动强烈，心率加快时可感到心脏跳动，甚至可感到心前区振动。本例患者中年女性，突发心悸，心律绝对不齐，心音强弱不等，可诊断为心房颤动（C对），其是患者心悸最可能的原因。窦性心律不齐（九版诊断学P508）（A错）是指窦性心律的起源未变，但节律不整。较常见的一类心律不齐与呼吸周期有关，称呼吸性窦性心律不齐，多见于青少年，一般无临床意义。窦性心律不齐患者不会出现心音强弱不等。窦性心动过速是指成人窦性心律的频率＞100次/分。发生窦性心动过速（B错）时心律一般规整。室性早搏（P197）（D错）后出现较长的代偿间歇，其第二心音减弱，仅能听到第一心音，桡动脉搏动减弱或消失。房性早搏（E错）是指起源于窦房结以外的心房任一部位的心房激动，主要表现为心悸，也可无任何症状，多为功能性，若发生频率不高，通常影响不大，若频率过高，则易引起严重的心律不齐，影响心脏功能，心音强弱不等少见。